蕲蛇除祛风通络外，又能
A. 清热解毒
B. 凉血消肿
C. 定惊止痉
D. 利湿退黄
E. 活血散结

正确答案：C。定惊止痉

解析：本题考查蕲蛇的功效。蕲蛇除祛风通络外，又能定惊止痉（C对）。蕲蛇【功效】祛风通络，定惊止痉。豨莶草【功效】祛风湿，通经络，清热解毒（A错），降血压。紫花地丁【功效】清热解毒，凉血消肿（B错）。垂盆草【功效】清热解毒，利湿退黄（D错）。海马【功效】补肾助阳，活血散结（E错），消肿止痛。